慢性支气管炎发展成阻塞性肺气肿的过程中最先发生的病理改变是
A. 肺泡膨胀
B. 细支气管不完全阻塞
C. 肺泡壁弹性减退
D. 肺小动脉痉挛
E. 肺纤维化

正确答案：B。细支气管不完全阻塞

解析：阻塞性肺气肿的发生是在慢性支气管炎的基础上发展而来。慢性支气管炎发生后，各级支气管壁发生以中性粒细胞和淋巴细胞为主的多种炎症细胞浸润，中性粒细胞释放蛋白酶破坏粘膜下层平滑肌，使其断裂，随后平滑肌自我修复，形成纤维，纤维收缩导致细支气管不完全阻塞（B对）。胸廓扩张时，肺组织牵拉支气管，气体可进入肺泡内，当胸廓复位时，肺内压增加，挤压支气管，支气管闭塞，造成呼气性呼吸困难，肺泡膨胀（A错），随着病变加重，肺泡弹性减退（C错），肺泡进一步增大，压迫周围小动脉，造成肺动脉高压，肺小动脉痉挛（D错）。肺纤维化（E错）多发生于肺间质疾病，而不为阻塞性肺气肿的病理改变。